具有干涩伤津致病特点的邪气是
A. 燥邪
B. 火邪
C. 风邪
D. 寒邪
E. 湿邪

正确答案：A。燥邪

解析：燥性干涩，易伤津液（A对），燥易伤肺；燥邪为干涩之病邪，侵犯人体，最易损伤津液，出现各种干燥、涩滞的症状。火热为阳邪，其性炎上，易扰神，易伤津耗气（B错），易生风动血，易致疮痈。风为阳邪，轻扬开泄，易袭阳位，其性善行而数变，风性主动，为百病之长（C错）。寒为阴邪，易伤阳气，其性凝滞主痛，性收引（D错）。湿为阴邪，易伤阳气，易阻气机，其性重浊粘滞，湿性趋下，易袭阴位（E错）。